防治皮肤粘膜变态反应性疾病宜选用
A. 异丙肾上腺素
B. 氨茶碱
C. 西咪替丁
D. 氯苯那敏
E. 特布他林

正确答案：D。氯苯那敏